颈内动脉不正确的说法是
A. 起于颈总动脉
B. 在颅外没有分支
C. 营养脑和视器
D. 经过颈动脉管进入颅内
E. 经过枕骨大孔进入颅内

正确答案：E。经过枕骨大孔进入颅内

解析：颈内动脉起于颈总动脉（A对），在颅外没有分支（B对），营养脑和视器（C对），经过颈动脉管（D对E错，为本题正确答案）进入颅内。